《金匮要略》用黄芪桂枝五物汤治疗
A. 黄汗
B. 百合病
C. 风水
D. 历节
E. 血痹

正确答案：E。血痹

解析：本条论述血痹重证的证治。阴阳俱微是素体营卫气血不足；寸口关上微，尺中小紧，是阳气不足、阴血涩滞的表现，即阳不足而阴为痹。血痹病以局部肌肤麻木不仁为特征，如受邪较重，可兼有酸痛感，所以说“如风痹状”。但血痹与风痹是有区别的：前者以麻木为主。后者以疼痛为主。黄芪桂枝五物汤，即桂枝汤去甘草，倍生姜，加黄芪组成。方中黄芪甘温益气，倍生姜助桂枝以通阳行痹，芍药和营理血，生姜、大枣调和营卫。五药相合，温、补、通、调并用、共奏益气通阳、和营行痹之效（E对）。